小蓟具有的功效是
A. 解毒消痈
B. 收湿敛疮
C. 消肿排脓
D. 化腐生肌
E. 燥湿止痒

正确答案：A。解毒消痈

解析：该题考查小蓟的功效，属记忆内容。小蓟为凉血止血药，味甘、苦，性凉；入心、肝经；具有凉血止血，散瘀解毒消痈的功效（A对BCDE错）。